药品监督管理的限制性原则之一是
A. 保障人体用药安全
B. 维护人民身体健康
C. 保证药品质量
D. 管理效率与管理成本兼顾
E. 不允许侵害有关药事组织或公众的合法权益

正确答案：E。不允许侵害有关药事组织或公众的合法权益